阿托品明显中枢中毒剂量为
A. 5mg以上
B. 10mg以上
C. 15mg以上
D. 20mg以上
E. 30mg以上

正确答案：B。10mg以上

解析：中毒剂量（10mg以上）可见明显中枢中毒症状。掌握“阿托品”知识点。